关于肾纤维囊的描述，错误的是
A. 较薄
B. 致密坚韧
C. 含少量弹性纤维
D. 位于肾被膜的最外层
E. 正常情况下易与肾实质分离

正确答案：D。位于肾被膜的最外层

解析：位于肾被膜的最外层（D错，为本题正确答案）为肾筋膜。肾纤维囊坚韧而致密（B对），较薄（A对），含致密结缔组织和少量弹性纤维（C对），易于剥离（E对），如剥离困难即为病理现象。